急性重型肝炎诊断的重要依据是
A. 凝血酶原活动度＜40%
B. 胆红素＞17.lμmol/L
C. 碱性磷酸酶明显升高
D. 丙氨酸转氨酶明显升高
E. 甲胎蛋白升高

正确答案：A。凝血酶原活动度＜40%

解析：急性重型肝炎诊断的重要依据是凝血酶原活动度≤40%（A对），血清胆红素＞17lμmol/L（大于正常上限的10倍）（B错）。碱性磷酸酶明显升高提示胆管梗阻等（C错）。丙氨酸转氨酶明显升高可见于各种病毒性肝炎、酒精肝等（D错）。急性重型肝炎患者甲胎蛋白增高，提示有肝细胞再生，为预后良好的标志（E错）。